聚山梨酯80在混悬液型液体药剂中常作为
A. 乳化剂
B. 助溶剂
C. 润湿剂
D. 助悬剂
E. 絮凝剂

正确答案：C。润湿剂

解析：本题考查混悬剂的稳定剂。聚山梨酯80在混悬液型液体药剂中常作为润湿剂（C对）。混悬剂的稳定剂主要起润湿、助悬、絮凝或反絮凝等作用，以使混悬剂稳定。润湿剂：用疏水性药物配制混悬液时，必须加入润湿剂，使药物能被水润湿。润湿剂作用原理是降低固-液二相界面张力，因此一些表面活性剂如聚山梨酯类、聚氧乙烯脂肪醇醚以及长链烃基或烷烃芳基的硫酸盐和磺酸盐均可用作润湿剂。助悬剂（D错）：助悬剂的作用是增加混悬液中分散介质的黏度，从而降低药物微粒的沉降速度，它又能被药物微粒表面吸附，形成机械性或电性的保护膜，防止微粒间互相聚集或结晶的转型，或者使混悬剂具有触变性，从而使混悬剂的稳定性增加。通常可根据药物微粒的性质与含量，选择不同的助悬剂。絮凝剂（E错）与反絮凝剂：混悬剂中加人适量的电解质，可使ξ电位降低到一定程度，即微粒间的排斥力稍低于吸引力，微粒呈疏松的絮状聚集体，经振摇又可恢复成均匀的混悬剂，这个现象叫絮凝，所加人的电解质称为絮凝剂。如加入电解质后使ξ电位升高，阻碍微粒之间的碰撞聚集，这个过程称为反絮凝，能起反絮凝作用的电解质称为反絮凝剂，适宜的反絮状体系也有利于混悬剂的稳定性。乳化剂（A错）：在两种不相混溶的液体体系中，由于第三种物质的加人，使其中一种液体以小液滴的形式均匀分散在另一种液体中的过程称为乳化，具有乳化作用的物质称为乳化剂。助溶剂（B错）：一些难溶于水的药物由于加入第二种物质面增加其在水中的溶解度的现象，称为助溶，该第二种物质称为助溶剂。